微量元素的摄入与机体有害效应的产生，下面正确的叙述是
A. 任何一种微量元素摄入过高
B. 任何一种微量元素摄入不足
C. 任何一种微量元素摄入过高和摄入不足
D. 某些微量元素摄入过高或过低
E. 以上都不是

正确答案：C。任何一种微量元素摄入过高和摄入不足

解析：本题考查微量元素的相关内容。必需微量元素具有两重性，由于必需微量元素具有多种重要的生物学效应，当机体摄入不足或缺乏时可导致某些生理功能障碍、生化代谢失调、甚至出现组织器官病理性损伤和疾病发生。摄入过量也会对人体产生危害，尤其是那些安全范围较窄的微量元素，易出现摄入过量中毒。这里的必需微量元素包括任意一种必需微量元素（C对ABDE错）。